女，28岁。妊娠36周，枕右前位，出现阴道流血，无宫缩，胎心136次/分。最恰当处理方法应是
A. 缩宫素静脉滴注引产
B. 立即行人工破膜
C. 观察一周再行处理
D. 立即静脉滴注止血药物
E. 行剖宫产术

正确答案：C。观察一周再行处理

解析：青年孕妇，妊娠36周，无宫缩，出现阴道流血（前置胎盘的典型症状为出现无诱因、无痛性阴道流血），可考虑为前置胎盘，胎心136次/分（正常值110～160次/分），孕妇一般情况良好，可观察一周再行处理（C对）。缩宫素静脉滴注引产（P189）（A错）适用于协调性宫缩乏力或不协调宫缩乏力恢复协调性时。立即行人工破膜（B错）适用于协调性宫缩乏力，宫口扩张≥3cm、无头盆不称、胎头已衔接而产程延缓者。怀孕期间不建议服用止血药，以免对胎儿有影响，因此立即静脉滴注止血药物（D错）不恰当。当出现持续大量阴道流血、胎儿窘迫等情况时，行剖宫产术（E错）。